关于涉及人的生物医学研究的国际性著名文件是
A. 《夏威夷宣言》
B. 《赫尔辛基宣言》
C. 《希波克拉底誓言》
D. 《东京宣言》
E. 《悉尼宣言》

正确答案：B。《赫尔辛基宣言》